化学结构分类不属于黄酮类化合物的是
A. 黄酮醇类
B. 花色素类
C. 蒽酮类
D. 橙酮类
E. 查耳酮类

正确答案：C。蒽酮类

解析：本题考查的是黄酮类化合物的分类。化学结构分类不属于黄酮类化合物的是蒽酮类（C错，为本题正确答案）。蒽酮类属于醌类化合物。黄酮醇类（A对）、花色素类（B对）、橙酮类（D对）与查耳酮类（E对）均属于黄酮类化合物。